有助于诊断肝性脑病的血液化验指标是
A. 血氨
B. 丙氨酸氨基转移酶
C. 白蛋白
D. 血小板计数
E. 球蛋白

正确答案：A。血氨

解析：肝性脑病，是严重肝病引起的、以代谢紊乱为基础的中枢神经系统功能失调的综合病征，其主要临床表现是意识障碍、行为失常和昏迷。氨中毒是肝性脑病的主要原因，血氨检测对肝性脑病具有很高的敏感性特异性（A对）。球蛋白、丙氨酸氨基转移酶、白蛋白主要反映肝脏病变严重程度，不能反映肝性脑病严重程度（BCE错）。血小板计数有助于对止血和血栓性疾病的诊断和鉴别诊断（D错）。